基因诊断及治疗所带来的伦理问题应除外
A. 胎儿生命权与父母选择权可能出现冲突
B. 人类遗传物质的纯洁性、神圣性是否受到了亵渎
C. 诊断及治疗时导人的基因如何正确表达
D. 对个体和人类社会是否安全
E. 生殖细胞的基因治疗是否可行

正确答案：C。诊断及治疗时导人的基因如何正确表达